实验室内常用的连接外源性DNA载体的酶是
A. Taq酶
B. T₄DNA连接酶
C. DNA聚合酶Ⅰ
D. DNA聚合酶Ⅱ
E. DNA聚合酶Ⅲ

正确答案：B。T₄DNA连接酶